完全性前置胎盘不可能发生在下述何种情况
A. 胎位LST，单臀，先露未入盆
B. 胎位RSP
C. 胎位LOP，胎头未入盆
D. 胎位ROA先露已衔接
E. 胎位LOT，先露高浮

正确答案：D。胎位ROA先露已衔接

解析：本题问的是完全性前置胎盘，完全性前置胎盘时，胎先露是不可能衔接的。边缘性前置胎盘，胎先露有可能衔接。完全性前置胎盘时胎先露应是高浮的，所以，不论何种胎位，都不可能衔接。掌握“前置胎盘”知识点。